以下关于牙体近远中向倾斜规律的描述中，不恰当的是
A. 上下前磨牙与第一磨牙向近中倾斜的程度较小并依次增大
B. 上下颌第二、第三磨牙向近中倾斜度依次加大
C. 下颌中切牙较正，侧切牙稍向近中倾斜
D. 下颌尖牙倾斜度较下颌中切牙、侧切牙大
E. 上颌侧切牙向近中倾斜角度较中切牙和尖牙者大

正确答案：A。上下前磨牙与第一磨牙向近中倾斜的程度较小并依次增大

解析：下颌中切牙较正，侧切牙稍向近中倾斜，尖牙比前两者都大，但倾斜度均较上颌前牙小。上下前磨牙与第一磨牙向近中倾斜的程度较小并依次减小，最后与中线接近平行。上下颌第二、第三磨牙向近中倾斜度依次加大。掌握“牙列”知识点。